女，30岁。面部皮疹、发热1个月，水肿1周。查体：T37.8℃，BP160/100mmHg。颜面可见充血性皮疹，腹部移动性浊音（+），双下肢中度凹陷性水肿。血常规：Hb96g/L，WBC3.1×10⁹/L，Plt67×10⁹/L。尿沉渣镜检RBC满视野，WBC8~10/HP。尿蛋白定量4.2g/24h。肾功能正常，血C3下降。为明确诊断，最有价值的实验室检查是
A. 血lgA及lgE
B. 血抗中性粒细胞胞浆抗体
C. 血抗链珠向溶血素“O”
D. 乙肝病毒标志物
E. 血抗核抗体及抗双链DNA抗体

正确答案：E。血抗核抗体及抗双链DNA抗体

解析：患者青年女性，为系统性红斑狼疮（SLE）常见发病年龄，面部充血性皮疹（SLE常见表现）、发热（全身症状）1个月，腹部移动性浊音（+）（SLE累及消化系统表现）；尿沉渣镜检RBC满视野，WBC8~10/HP。尿蛋白定量4.2g/24h，双下肢中度凹陷性水肿（SLE累及肾脏表现）；血常规：Hb96g/L（正常女性Hb＞110g/L），WBC3.1×10⁹/L（正常为4-10×10⁹/L），Plt67×10⁹/L（SLE累及血液系统改变）；患者出现多系统功能受损症状，根据临床表现、体征及已给检查，应考虑患者所患疾病为系统性红斑狼疮狼疮肾炎，想进一步确诊，可进行血抗核抗体及抗双链DNA抗体检查（E对）。血抗核抗体（ANA）灵敏度高，特异度低，见于几乎所有的SLE病人；抗双链DNA抗体（抗dsDNA抗体）特异度高，为SLE的标记抗体，抗dsDNA抗体的滴度与疾病活动性密切相关，所以血抗核抗体及抗双链DNA抗体为确诊SLE的最有价值的实验室检查。